对伴有哮喘的心绞痛患者更适用的药物是
A. 普萘洛尔
B. 哌唑嗪
C. 硝苯地平
D. 硝酸甘油
E. 氯沙坦

正确答案：C。硝苯地平

解析：本题考查硝苯地平。对伴有哮喘的心绞痛患者更适用的药物是硝苯地平（C对）。硝苯地平作为第一代二氢吡啶类比第二代氨氯地平、非洛地平负性肌力更大，变异型心绞痛最为有效，对伴有哮喘和阻塞性肺疾病患者更为适宜。普萘洛尔（A错）可治疗稳定型及不稳定型心绞痛，可减少发作次数，对兼患高血压或心律失常者更为适用。哌唑嗪（B错）适用于各型高血压，单用治疗轻、中度高血压，重度高血压合用利尿药和β受体阻断药可增强降压效果。硝酸甘油（D错）通过降低心肌耗氧量、舒张冠状动脉、增加缺血区血液灌注可用于治疗各种类型心绞痛（包括劳累型心绞痛、变异型心绞痛以及不稳定型心绞痛）。氯沙坦（E错）为血管紧张素Ⅱ受体阻断药，用于轻、中度高血压，适用于不同年龄的高血压患者，对伴有糖尿病、肾病和慢性心功能不全患者有良好疗效。